方是
A. 少腹逐瘀汤
B. 血府逐瘀汤
C. 四物汤合失笑散
D. 膈下逐瘀汤
E. 桃红四物汤

正确答案：A。少腹逐瘀汤

解析：题干中患者结婚2年未孕，经行量少不畅，经色紫黯有块，腹痛拒按喜暖，舌质黯，脉弦为不孕证瘀滞胞宫证，选方少腹逐瘀汤（A对）。血府逐瘀汤主治胸中血瘀证（B错）。四物汤合失笑散补血养血，活血祛瘀，散结止痛（C错）。膈下逐瘀汤活血祛瘀，行气止痛（D错）。桃红四物汤养血活血，主治血虚兼血瘀证（E错）。